男，25岁。乏力、消瘦、腹胀2个月。查体：心肺未见异常，肝肋下1cm，脾肋下8cm。化验Hb138g/L，WBC96×10⁹/L，Plt385×10⁹/L。分子生物检查可见bcr/abl融合基因。该患者最有效的治疗是
A. 口服伊马替尼
B. DA方案化疗
C. 口服苯丁酸氮芥
D. 脾切除
E. VLDP方案

正确答案：A。口服伊马替尼

解析：患者诊断为慢性粒细胞白血病，最有效的治疗为口服分子靶向药物伊马替尼（A对），伊马替尼为酪氨酸激酶抑制剂，可使慢粒患者获得较高的细胞遗传学缓解率。DA方案（P576）（B错）是急性髓系白血病的首选治疗方案；苯丁酸氮芥（P581）（C错）主要用于慢性淋巴细胞白血病的治疗；脾切除（D错）用于脾亢、遗传性球形细胞增多症等的治疗，慢粒脾脏肿大虽显著，但其属于恶性血液病，脾切除效果不佳；VLDP方案（P575）（E错）是急性淋巴细胞白血病的首选治疗方案。